下列关于直线回归的说法，错误的是
A. 回归分析前应绘制散点图
B. 回归方程可用来描述两定量变量间数量依存变化的关系
C. 对回归系数假设检验的P能够反映自变量对应变量数量上的影响大小
D. 满足各观测值独立、应变量与自变量关系为线性、误差服从正态分布的资料才能应用于回归分析
E. 直线回归用于预测时，自变量一般不应超出样本实测值的取值范围

正确答案：C。对回归系数假设检验的P能够反映自变量对应变量数量上的影响大小